过敏性接触性口炎多为
A. Ⅰ型超敏反应
B. Ⅱ型超敏反应
C. Ⅲ型超敏反应
D. Ⅳ型超敏反应
E. Ⅴ型超敏反应

正确答案：D。Ⅳ型超敏反应

解析：过敏性接触性口炎多为Ⅳ型超敏反应。掌握“常见口腔过敏反应性疾病”知识点。